产科意外时DIC发生率高，其主要的诱发因素是
A. 纤溶酶原水平低
B. 纤维蛋白原含量高
C. 肝清除活化的凝血因子能力降低
D. 器官微循环障碍
E. 血液处于高凝状态

正确答案：E。血液处于高凝状态

解析：产科意外时DIC发生率高，其主要的诱发因素是血液处于高凝状态（E对ABCD错）。妊娠第三周开始，孕妇血液中血小板及凝血因子(I、II、V、VII、IX、X、XII等）逐渐增多；而AT­III、组织型纤溶酶原激活物、尿激酶型纤溶酶原激活物降低；胎盘产生的PAI增多。随着妊娠时间的增加，血液处于高凝状态，妊娠末期最明显 。故当产科意外（胎盘早期剥离、宫内死胎、羊水栓塞等）时，易发生DIC。